某患者因类风湿关节炎服用雷公藤制剂，执业药师对其进行用药指导，正确的建议有
A. 服药期间可能出现腹痛、腹泻、恶心、呕吐等消化系统症状
B. 定期检测血常规，关注血小板、白细胞、血红蛋白等的变化
C. 本药可抑制男女生殖功能有生育需求者禁用
D. 服药期间可能出现头晕失眠、听力减退等神经系统症状
E. 出现任何不良反应必须立即停药

正确答案：A、B、C、D、E。服药期间可能出现腹痛、腹泻、恶心、呕吐等消化系统症状；定期检测血常规，关注血小板、白细胞、血红蛋白等的变化；本药可抑制男女生殖功能有生育需求者禁用；服药期间可能出现头晕失眠、听力减退等神经系统症状；出现任何不良反应必须立即停药

解析：本题考查的是中药饮片的不良反应。某患者因类风湿关节炎服用雷公藤制剂，执业药师对其进行用药指导，正确的建议有服药期间可能出现腹痛、腹泻、恶心、呕吐等消化系统症状（A对）、定期检测血常规，关注血小板、白细胞、血红蛋白等的变化（B对）、本药可抑制男女生殖功能有生育需求者禁用（C对）、服药期间可能出现头晕失眠、听力减退等神经系统症状（D对）与出现任何不良反应必须立即停药（E对）。雷公藤的不良反应表现：①消化系统：腹痛、腹泻，恶心、呕吐，食欲不振，肝损害，少数可致伪膜性肠炎，严重者可致消化道出血。②血液系统：血小板、白细胞、血红蛋白减少，严重者可发生急性粒细胞减少、再生障碍性贫血等。③生殖系统：对男性患者雷公藤可抑制精细胞中酶的活性，导致精子产生和成熟发生障碍，表现为精子数量显著减少，长期用药还会导致性欲减退、睾丸萎缩；对女性患者雷公藤可抑制其卵巢功能，表现为月经紊乱、经量减少、卵巢早衰。④神经系统：头晕、乏力、失眠、听力减退、嗜睡、复视，还可引起周围神经炎。⑤泌尿系统：主要表现为急性肾功能衰竭，服药后迅速出现或逐渐发生少尿、水肿、血尿、蛋白尿、管型尿、腰痛或伴肾区叩击痛，常常发生于过量中毒时。⑥心血管系统：心悸、胸闷、心动过缓、气短、心律失常、心电图改变（ST-T改变），严重者可见血压急剧下降，个别出现室颤、心源性休克而死亡。⑦皮肤黏膜损害：皮肤糜烂、溃疡、斑丘疹、荨麻疹、瘙痒等。不良反应的紧急处理：中毒后立即停药、催吐、洗胃、导泻、灌肠。静脉输液。雷公藤制剂的不良反应表现：药物性肝炎、肾功能不全、粒细胞减少、白细胞减少、血小板减少、闭经、精子数量减少、心律失常等；严重者有肝肾功能异常、肾功能衰竭、胃出血等。用药指导：①患者服用该类药物时，必须在医师的指导下使用，用药初期从最小剂量开始。②严格控制用药剂量和疗程，一般连续用药不宜超过3个月。③用药期间应定期随诊并注意检查血、尿常规，加强心电图和肝肾功能监测。④儿童、育龄期有孕育要求者、孕妇和哺乳期妇女禁用；心、肝、肾功能不全者禁用；严重贫血、白细胞和血小板降低者禁用；胃、十二指肠溃疡活动期及严重心律失常者禁用。老年有严重心血管病者慎用。